热辐射强度的单位为
A. kCal/（cm²·min）
B. J/（cm²·min）
C. Cal/（cm²·min）
D. J/（m²·min）
E. kCal/（m²·min）

正确答案：B。J/（cm²·min）

解析：本题考查热辐射强度的单位。热辐射强度的单位为J/（cm²·min）（B对ACDE错）。